关于药典及药品标准的叙述，不正确的是
A. 药品标准是药品生产、供应、使用、检验和管理的法定依据
B. 药典是一个国家记载药品质量规格、标准的法典，具有法律的约束力
C. 已颁布施行的《中国药典》均分为一、二两部
D. 《新修本草》是世界上最早的一部全国性药典
E. U.S.P和P分别为美国和英国药典的英文缩写

正确答案：C。已颁布施行的《中国药典》均分为一、二两部